用于鉴定挥发油组成成分的有效方法是
A. 纸色谱
B. 气相色谱
C. 紫外光谱
D. 分馏
E. 重结晶

正确答案：B。气相色谱

解析：本题考查的是气相色谱法。用于鉴定挥发油组成成分的有效方法是气相色谱（B对）。气相色谱是研究挥发油组成成分非常有效的方法，特别是应用制备型气相色谱-质谱联用技术，可成功地将挥发油中众多成分予以分离并同时进行鉴定。纸色谱（A错）法实质上也是液液萃取法的原理，只是两相中其中一相以固态为基质，与某种液相形成饱和状态，进而达到分离的目的。紫外（UV）光谱（C错）的测定仅需要少量的纯样品，这对于中药化学成分的研究是非常有利的。一般来说，UV光谱主要提供化合物分子中共轭体系的结构信息，可据此判断共轭体系中取代基的种类、位置和数目。分馏法（D错）是根据物质的沸点进行分离。通常利用中药中各成分沸点的差别进行分离，一般来说，液体混合物沸点相差在100℃以上时，可用反复蒸馏法达到分离的目的，如沸点相差在25℃以下，则需要采用分馏柱，沸点相差越小，则需要的分馏装置越精细。重结晶法（E错）从不纯的结晶经过进一步加溶剂结晶进行精制处理得到较纯结晶的过程称为重结晶。